初次应答最主要的特点是
A. IgG大量产生
B. IgG产生的快
C. IgG和IgM同时产生
D. 抗体产生的潜伏期长
E. IgG的亲和力强

正确答案：D。抗体产生的潜伏期长

解析：机体初次接触抗原所产生的抗体应答。其抗体产生的潜伏期长、滴度低、维持时间短、亲和力低，主要为IgM。掌握“B细胞、T细胞介导的免疫应答”知识点。